患者，女性，38岁。患小细胞低分化肺癌已做了3个疗程的化疗和放疗，其丈夫极为关心其预后问题。下列哪项不是帮助判断预后的主要因素
A. TNM分期
B. 免疫功能
C. 身体基础状态
D. 肺癌的组织病理学类型
E. 其丈夫是否戒烟

正确答案：E。其丈夫是否戒烟

解析：小细胞低分化肺癌是恶性程度很高的肺癌，很早即会发生潜在性血道、淋巴道微转移灶，确诊时50%左右的患者已发生远处转移病灶。即便是尚有机会做手术治疗，其5年存活率也仅为28.9%～51%，此组织类型的肺癌预后十分不好。该患者即使是已经做了3个疗程的化疗和放疗，预后也不容乐观，与其自身的免疫功能、基础状态（包括骨髓功能）、TNM分期很有关系，但与其丈夫是否戒烟关系不大，故应该选答案E。掌握“肺癌”知识点。